气虚证可见
A. 头晕目眩
B. 面色淡白
C. 二者均有
D. 二者均无

正确答案：A。头晕目眩

解析：本题考查的是气虚证的临床表现。气虚证可见头晕目眩（A对）。气虚证的临床表现及辨证要点：气虚证的临床表现，常见头晕目眩，少气懒言，疲倦乏力，自汗，活动时诸症加剧，舌淡，脉虚无力。一般以全身功能活动低下为辨证要点。面色苍白（B错）为血虚证的临床表现。血虚证的临床表现及辨证要点：血虚证的临床表现，常见面色苍白或萎黄，唇色淡白，头晕眼花，心悸失眠，手足发麻，妇女经行量少、愆期甚或经闭，舌质淡，脉细无力。一般以面色、口唇、爪甲失其血色及全身虚弱为辨证要点。